视网膜节细胞轴突经过
A. 黄斑中央凹
B. 视神经盘
C. 虹膜
D. 睫状小带
E. 睫状体

正确答案：B。视神经盘

解析：视网膜节细胞轴突经过视神经盘（B对）。